无细胞壁的原核细胞型微生物是
A. 真菌
B. 衣原体
C. 支原体
D. 病毒
E. 立克次体

正确答案：C。支原体

解析：根据表22-1 病毒与其他微生物的比较可将选项涵盖，支原体（C对）即为无细胞壁的原核细胞型微生物，真菌（A错）为真核细胞型微生物，它的细胞壁由几丁质或纤维素构成（P318），衣原体（B错）为具有细胞壁的原核细胞型微生物，它的原体形态具有细胞壁而网状体状态不具有细胞壁，且其细胞壁的抗原成分可分为属、种、型特异性抗原，病毒（D错）为非细胞型微生物，立克次体（E错）为一类以节肢动物为传播媒介的具有细胞壁的原核细胞型微生物，它的细胞壁含肽聚糖和脂多糖（P175）。